急性白血病诊断的主要依据是
A. 发热、贫血、出血
B. 白细胞计数＞50×10⁹/L
C. 骨髓增生极度活跃
D. 胸骨压痛（+）
E. 骨髓中原始细胞明显增高

正确答案：E。骨髓中原始细胞明显增高

解析：急性白血病诊断的主要依据是骨髓象检查骨髓中原始细胞明显增高（E对），原始细胞≥骨髓有核细胞（ANC）的30%（FAB分型）或≥20%（WHO分型），即可诊断为急性白血病。发热、贫血、出血（P571）（A错）是正常骨髓造血受白血病细胞抑制的表现，还可见于再障、骨髓增生异常综合征等，不具有特异性；白细胞计数＞50×10⁹/L（B错）可见于白细胞增多性白血病、类白血病反应等，急性白血病时白细胞亦可正常或减低；骨髓增生极度活跃（P572）（C错）可见于多数急性白血病及慢性粒细胞白血病，少数急性白血病可增生减低；胸骨压痛（+）（D错）可见于白血病、恶性肿瘤胸骨转移、外伤等，不具有诊断价值。